患者戴用全口义齿1周后，自诉义齿易松动。在询问病史时，要着重问的是
A. 怎样松动
B. 松动程度如何
C. 何时义齿松动
D. 过去是否戴过义齿
E. 是否能吃饭

正确答案：C。何时义齿松动

解析：本题考查询问病史-固位不良。全口义齿易松动即固位不良。固位不良的原因是多方面的。一方面是由于患者口腔条件差，另一方面是由于义齿本身的问题造成。当患者出现义齿松动现象，询问病史时应着重问何时义齿松动（C对），以此来判断义齿的问题出现在哪里，加以解决。常见的现象及原因如下：1.当口腔处于休息状态时，义齿容易松动脱落。这是由于基托边缘伸展不够，边缘封闭作用不好造成。2.当口腔处于休息状态时，义齿固位尚好，但张口、说话、打哈欠时义齿易脱位，是由于基托边缘过长、过厚、系带区缓冲不够、人工牙排列位置不当等原因造成。3.固位尚好，但在咀嚼食物时，义齿容易脱位这是由于（牙合）不平衡，下颌磨牙后垫部位基托伸展过长等原因造成。